左心功能不全时发生呼吸困难的主要机制是
A. 肺动脉高压
B. 肺淤血、肺水肿
C. 深睡眠时迷走神经紧张性增高
D. 平卧时静脉回流加速
E. 平卧时胸腔容积减少

正确答案：B。肺淤血、肺水肿

解析：左心功能不全时，左室输出量减少，舒张期充盈压升高，使肺循环血液回流受阻，造成肺循环淤血，严重时可出现肺水肿（B对）（血浆渗出到肺泡及肺间质）。肺淤血、肺水肿的共同表现是呼吸困难，根据肺淤血水肿的严重程度，呼吸困难又可分为劳力性呼吸困难、夜间阵发性呼吸困难、端坐呼吸。C、D、E选项均是夜间阵发性呼吸困难的发生机制，不能代表左心功能不全时发生呼吸困难的主要机制。